小檗碱具有
A. 发汗、平喘作用
B. 抗菌作用
C. 降血脂作用
D. 镇静、麻醉作用
E. 消肿利尿、抗肿瘤作用

正确答案：B。抗菌作用

解析：本题考查的是小檗碱的生物活性。小檗碱具有抗菌作用（B对）。黄连的药理作用：（1）抗菌、抗病毒：黄连的抗菌谱广，对革兰阳性和革兰阴性、结核杆菌、真菌等均有抑制或杀灭作用。黄连对钩端螺旋体、幽门螺杆菌也有抑制作用。黄连的抗菌有效成分主要是小檗碱。黄连制剂、小檗碱对各型流感病毒均有抑制作用。（2）抗毒素、抗腹泻：黄连、小檗碱能提高机体对多种细菌毒素的耐受力，从而改善毒血症状。黄连对细菌内毒素所致大鼠死亡有保护作用，小檗碱能对抗蓖麻油、番泻叶等所致的小鼠腹泻，也能对抗霍乱弧菌毒素和大肠杆菌毒素所致的严重腹泻。（3）解热、抗炎：黄连及小檗碱对多种致热物质如牛奶、酵母引起的动物发热有解热作用。黄连的甲醇提取物能对抗多种实验性大鼠足肿胀和肉芽肿，局部用药也能减轻肉芽肿的发展。小檗碱对多种实验性炎症早期渗出、水肿和晚期肉芽增生都有明显的抑制作用。（4）降血糖：黄连煎剂及小檗碱能降低肾上腺素、四氧嘧啶和自发性糖尿病动物的血糖水平，并改善葡萄糖耐量。发汗、平喘作用（A错）为麻黄的药理作用。麻黄的药理作用：（1）发汗；（2）平喘、镇咳、祛痰；（3）利尿；（4）解热、镇痛、抗炎。降血脂作用（C错）为何首乌的药理作用。何首乌的药理作用：（1）促进造血功能；（2）降血脂、抗动脉粥样硬化；（3）增强免疫功能。镇静、麻醉作用（D错）为洋金花的药理作用。洋金花中生物碱的药理作用：莨菪碱及其外消旋体阿托品有解痉镇痛、解有机磷中毒和散瞳作用；东莨菪碱除具有莨菪碱的生理活性外，还有镇静、麻醉作用。消肿利尿、抗肿瘤作用（E错）为苦参的药理作用。苦参的药理作用：苦参总生物碱具有抗肿瘤、抗病原微生物、抗心律失常、解热、抗炎、抗变态反应和调节免疫等作用。